休克初期微循环的变化以下哪一项是错误的？
A. 微动脉收缩
B. 后微动脉收缩
C. 毛细血管前括约肌收缩
D. 动静脉吻合支收缩
E. 微静脉收缩

正确答案：D。动静脉吻合支收缩

解析：休克初期在临床上属于休克代偿期，此期微循环血液灌流减少，组织缺血缺氧，这是因为全身小血管，包括小动脉、微动脉（A对）、后微动脉（B对）、毛细血管前括约肌（C对）和微静脉（E对）、小静脉都发生收缩痉挛，口径明显变小，尤其是毛细血管前阻力血管收缩更明显，前阻力增加，大量真毛细血管网关闭，微循环内血液流速减慢，轴流消失，血细胞出现齿轮状运动。动静脉吻合支收缩（D错，为本题正确答案）不是休克初期微循环的变化。